左肺叙述错误的是
A. 较右肺窄长
B. 纵隔面凹陷
C. 前缘有心切迹
D. 下方与胃相邻
E. 胸肋面与心、心包相邻

正确答案：E。胸肋面与心、心包相邻

解析：左肺较右肺窄长（A对）。左肺纵隔面凹陷，凹陷处称肺门（B对）。左肺前缘下部有心切迹（C对）。左肺下方与胃相邻（D对）。左肺胸肋面与胸廓的侧壁和前、后壁相邻（E错，为本题正确答案）。